需氢氧化钙护髓的牙外伤
A. 年轻恒牙冠折牙本质暴露
B. 年轻恒牙根折
C. 全脱位半小时的恒牙
D. 乳牙嵌入
E. 乳牙牙齿震荡

正确答案：A。年轻恒牙冠折牙本质暴露

解析：间接盖髓术：深龋引起的可复性牙髓炎、外伤冠折或牙体预备后的大面积牙本质暴露。掌握“年轻恒牙外伤”知识点。